口内注射法行下牙槽神经阻滞麻醉，病人应采取的体位是
A. 病人大张口，下颌牙（牙合）面与地面平行
B. 病人半张口，下颌牙（牙合）面与地面平行
C. 病人大张口，下颌牙（牙合）面与地面呈45°
D. 病人半张口，下颌牙（牙合）面与地面呈45°
E. 病人半张口，下颌牙（牙合）面与地面呈30°

正确答案：A。病人大张口，下颌牙（牙合）面与地面平行

解析：注射方法：病员大张口，下颌牙（牙合）平面与地面平行，将注射器放在对侧口角，即第一、第二前磨牙之间，与中线成45°角。注射针应高于下颌（牙合）平面1cm并与之平行。掌握“颌面部常用局麻法及牙拔除的麻醉选择”知识点。